患者久病，眼睑开合失司，下肢运动不利。其病在哪经
A. 阴跷脉、阳跷脉
B. 阴维脉、阳维脉
C. 督脉、任脉
D. 冲脉、任脉
E. 阴跷脉、阴维脉

正确答案：A。阴跷脉、阳跷脉

解析：跷脉，起于足踝下，从下肢内、外侧分别上行头面，具有交通一身阴阳之气和调节肢体肌肉运动的机能，主要使下肢运动灵活跷捷。阴阳跷脉交会于目内眦，阳跷主一身左右之阳，阴跷主一身左右之阴，所以能司眼睑开合。患者久病，眼睑开合失司，下肢运动不利为病在阴阳跷脉（A对）。阴维脉和阳维脉（B错）的生理功能：维系全身经脉。督脉（C错）调节阳经气血；反映脑、髓、肾的机能。任脉的生理功能：调节阴经气血；任主胞胎。冲脉的生理功能：调节十二经气血，与女子月经及孕育机能有关（D错）。